下列表述中属于证的是
A. 疟疾
B. 感冒
C. 头痛
D. 气滞
E. 发热

正确答案：D。气滞

解析：证，是对疾病过程中一定阶段的病因、病位、病性、病势等病机本质的概括。如脾胃虚弱证，病位在脾胃，病性为虚。证是病机的概括，病机是证的内在本质，证所反映的是疾病的本质。气滞属于证（D对）。疟疾属于病（A错）；感冒属于病（B错）：头痛属于病（C错）；发热属于症（E错）。